某温度计厂男工，42岁，工作十余年。近来有乏力、记忆力减退、失眠和多梦等症，常因琐事与人口角、事后又忧郁胆怯，近日发现他的字迹弯弯曲曲。最可能的诊断为
A. 慢性铅中毒
B. 慢性锰中毒
C. 慢性汞中毒
D. 慢性镉中毒
E. 慢性砷中毒

正确答案：C。慢性汞中毒

解析：本题考查慢性汞中毒症状。汞中毒（C对ABDE错）初期表现为类神经症，如头昏、乏力、健忘、失眠、多梦、易激动等，部分病例可有心悸、多汗等自主神经系统紊乱现象，病情进一步发展则会发生性格改变，如急躁、易怒、胆怯、害羞、多疑等。震颤是神经毒性的早期症状，如头部震颤和运动失调。题中工人的症状符合汞中毒的临床表现。